下列各项，对诊断肝性脑病最有意义的是
A. 血清尿素氮
B. 丙氨酸转移酶
C. 血氨
D. 血清胆红素
E. 尿酮体

正确答案：C。血氨

解析：肝性脑病是肝功能衰竭的终末期，肝病的晚期接待而发生的一种并发症。肝性脑病患者的血氨对蛋白和对血氨的代谢是正常人的三分之一都不到，若摄入了过多的蛋白质，体内因肝脏的合成能力下降，代谢能力下降，血氨就会明显的上升，也就提示着肝功能下降，所以血氨升高对诊断肝性脑病最有意义（C对）。血尿素氮测定是一项用于检查排尿功能是否正常的辅助检查方法（A错）。丙氨酸氨基转移酶是一种参与人体蛋白质新陈代谢的酶，对于一系列病毒性肝炎的诊断和分析有临床意义（B错）。血清胆红素可鉴别黄疸现象，也可反映体检者的肝脏损害程度（D错）。尿酮体是体内脂肪代谢的中间产物，尿酮体定性实验，常与糖尿病、妊娠、营养不良、慢性疾病有关（E错）。